芬太尼透皮贴用于中重度慢性疼痛，效果良好，其原因是
A. 经皮吸收，主要蓄积于皮下组织
B. 经皮吸收迅速，5～10分钟即可产生治疗效果
C. 主要经皮肤附属器如汗腺等迅速吸收
D. 经皮吸收后可发挥全身治疗作用
E. 贴于疼痛部位直接发挥作用

正确答案：D。经皮吸收后可发挥全身治疗作用

解析：本题考查芬太尼透皮贴。芬太尼透皮贴用于中重度慢性疼痛，效果良好，其原因是经皮吸收后可发挥全身治疗作用（D对E错）。芬太尼为中枢神经镇痛药，药物经皮吸收进入血液循环，到达中枢产生镇痛作用；药物通过皮肤进入血液循环，不会蓄积于皮下组织（A错）；经皮吸收起效慢（BC错）。